下列方剂中主治阳虚水泛的是
A. 苓桂术甘汤
B. 真武汤
C. 实脾散
D. 防己黄芪汤
E. 猪苓汤

正确答案：B。真武汤

解析：真武汤方含茯苓、芍药、白术、生姜、附子，可温阳利水，主治阳虚水泛证（B对）、太阳病发汗太过，阳虚水泛证。苓桂术甘汤主治中阳不足之痰饮正（A错）。实脾散主治脾肾阳虚，水气内停之阴水（C错）。防己黄芪汤主治表虚风水或风湿（D错）。猪苓汤主治水热互结伤阴证（E错）。